关于患病率下列说法不正确的是
A. 两周患病率是指调查前两周内患病人（次）数与调查人数的比率
B. 两周患病率主要是通过家庭健康询问调查得到的
C. 慢性病患病率是指调查前一年内患慢性病人（次）数与调查人数的比率
D. 两周患病率和慢性病患病率都是反映居民医疗服务需要量的指标

正确答案：C。慢性病患病率是指调查前一年内患慢性病人（次）数与调查人数的比率

解析：本题考查患病率的相关内容。两周患病率是指调查前两周内患病人（次）数与调查人数的比率（A对）。两周患病率主要是通过家庭健康询问调查得到的（B对）。慢性病患病率是指调查前半年内患慢性病人（次）数与调查人数的比率（C错，为本题正确答案）。两周患病率和慢性病患病率都是反映居民医疗服务需要量的指标（D对）。